口腔颌面部损伤时常影响呼吸或发生窒息的情况除外的是
A. 组织移位
B. 舌后坠
C. 血凝块
D. 颅内血肿
E. 分泌物的堵塞

正确答案：D。颅内血肿

解析：口腔颌面部在呼吸道始端，损伤时可因组织移位、肿胀、舌后坠、血凝块和分泌物的堵塞而影响呼吸或发生窒息。救治患者时，应注意保持呼吸道通畅，防止窒息。掌握“口腔颌面部创伤急救”知识点。